脊髓的抑制性中间神经元属于
A. 感受器
B. 传入神经
C. 神经中枢
D. 传出神经
E. 效应器

正确答案：C。神经中枢

解析：反射中枢的各类神经元通过在空间和时间上的多重复杂组合，可产生抑制和易化两种效果（P293），脊髓是低位神经反射中枢，因此它的抑制性中间神经元属于神经中枢。